中龋直接充填时，下列哪些材料对牙髓刺激最大
A. 聚羧酸水门汀
B. 氧化锌丁香油糊剂
C. 银汞合金
D. 复合树脂
E. 玻璃离子水门汀

正确答案：D。复合树脂

解析：本题考查对牙髓刺激最大的充填材料。复合树脂（D对）固化后仍有少量的残余单体，释放的残余单体在某些情况下对相邻的牙髓组织或牙龈差生轻微的刺激，充填修复深窝洞时，洞底应当先行垫底，以保护牙髓。聚羧酸水门汀（A错）充填入牙齿时的酸性可能刺激牙髓发生反应，但对于健康牙，牙髓反应是完全可逆的，所以中龋充填对牙髓刺激不大。氧化锌丁香油（B错）呈碱性，初期会对牙髓产生中等程度的炎症反应，以后逐渐减轻，并有修复性牙本质形成。银汞合金（C错）对牙髓刺激小，窝洞不深时可直接充填，对于需垫底者是因为银汞合金导热导电，垫底可避免电、热对牙髓的刺激。玻璃离子水门汀（E错）对牙髓的刺激性与聚羧酸锌水门汀相近，略大于氧化锌丁香油水门汀，低于磷酸锌水门汀。